男，38岁。发热伴腹胀、乏力1周。查体：T39℃，P84次/分，表情淡漠，胸部少许充血性皮疹，脾肋下可触及，质软。实验室检查：血WBC3.6×10⁹/L，N0.59，杆状核粒细胞0.01，L0.40。最可能得诊断是
A. 斑疹伤寒
B. 结核病
C. 疟疾
D. 伤寒
E. 布鲁菌病

正确答案：D。伤寒

解析：患者持续发热，消化系统异常（腹胀），神经系统出现中毒症状（表情淡漠），出现玫瑰疹（在发病一周后胸部出现充血皮疹），肝脾大等临床表现以及实验数据与伤寒症状体征及实验室检查结果相符，所以最可能的诊断为伤寒（D对）。斑疹伤寒（A错）起病4～5天后常见皮疹；结核病（B错）常见干咳、午后低热、盗汗、乏力，容易烦躁，食欲减退、体重减轻、妇女月经不正常等轻度毒性和植物神经紊乱的症状；疟疾（C错）常见间歇发热；布鲁菌病（E错）主要症状为发热、多汗、关节痛、睾丸肿痛等。